明矾不具有的功效是
A. 解毒杀虫
B. 清热消痰
C. 利水通便
D. 燥湿止痒
E. 止血止泻

正确答案：C。利水通便

解析：本题考查的是白矾的功效。明矾不具有的功效是利水通便（C错，为本题正确答案）。明矾即白矾。白矾：【功效】外用解毒杀虫（A对），燥湿止痒（D对）；内服止血止泻（E对），清热消痰（B对）。利水通便为郁李仁的功效。郁李仁：【功效】润肠通便，利水消肿。